以下关于新生儿腮腺的特点正确的是
A. 属纯黏液腺
B. 有少数混合腺泡
C. 混合性腺，以浆液腺腺泡为主
D. 混合性腺，以黏液性腺泡为主
E. 腮腺中可见少量黏液细胞

正确答案：E。腮腺中可见少量黏液细胞

解析：腮腺全部由浆液性腺泡组成，故属纯浆液腺，但在新生儿的腮腺中可见少量黏液细胞。掌握“唾液腺组织学特点”知识点。